婴幼儿易患呼吸道感染的主要原因是
A. 呼吸浅表
B. 呼吸频率快
C. 呈腹式呼吸
D. 呼吸道黏膜缺少SIgA
E. 鼻腔短小，狭窄，黏膜血管丰富

正确答案：D。呼吸道黏膜缺少SIgA

解析：小儿呼吸道的非特异性和特异性免疫功能均较差。婴幼儿的SIgA、IgA、IgG均降低，故易患呼吸道感染（D对）。E为上呼吸道（不是呼吸道）易发生感染的原因（E错），故最佳答案为D而不是E。婴幼儿易患呼吸道感染与ABC无关（ABC错）。